已知某医院2013年全年住院患者总数为20000例，该年上报的医院感染病例数为30例，漏报医院感染病例数为20例，所有医院感染病例中当年新发生的病例数为40例。该医院2013年的医院感染漏报率为
A. 0.001
B. 0.0015
C. 0.0025
D. 0.4
E. 0.6

正确答案：D。0.4